根据《中成药通用名称命名技术指导原则》，不属于中成药通用名称命名基本原则的是
A. 科学简明，避免重名
B. 规范命名，避免夸大疗效
C. 体现传统文化特色
D. 古今互通，拒绝迷信

正确答案：D。古今互通，拒绝迷信

解析：本题考查中成药通用名称命名。根据《中成药通用名称命名技术指导原则》，不属于中成药通用名称命名基本原则的是古今互通，拒绝迷信（D错，为本题正确答案）。中成药通用名称命名基本原则：（1）“科学简明，避免重名”（A对）原则。中成药通用名称应科学、明确、简短、不易产生歧义和误导，避免使用生涩用语。一般字数不超过8个字（民族药除外，可采用约定俗成的汉译名）。不应采用低俗、迷信用语。名称中应明确剂型，且剂型应放在名称最后。名称中除剂型外，不应与已有中成药通用名重复，避免同名异方、同方异名的产生。（2）“规范命名，避免夸大疗效”（B对）原则。中成药通用名称一般不应采用人名、地名、企业名称或濒危受保护动、植物名称命名。不应采用代号、固有特定含义名词的谐音命名。如：×0×、名人名字的谐音等。不应采用现代医学药理学、解剖学、生理学、病理学或治疗学的相关用语命名。如：癌、消炎、降糖、降压、降脂等。不应采用夸大、自诩、不切实际的用语。如：强力、速效、御制、秘制以及灵、宝、精等（名称中含药材名全称及中医术语的除外）。（3）“体现传统文化特色”原则（C对）。将传统文化特色赋予中药方剂命名是中医药的文化特色之一，因此，中成药命名可借鉴古方命名充分结合美学观念的优点，使中成药的名称既科学规范，又体现一定的中华传统文化底蕴。但是，名称中所采用的具有文化特色的用语应当具有明确的文献依据或公认的文化渊源，并避免夸大疗效。